能发生硫色素特征反应的药物是
A. 维生素B₁（盐酸硫胺）
B. 维生素C
C. 两者均能
D. 两者均不能

正确答案：A。维生素B₁（盐酸硫胺）

解析：本题考查常用的药品鉴别方法。能发生硫色素特征反应的药物是维生素B₁（盐酸硫胺）（A对）。硫色素反应是维生素B₁的专属性鉴别反应。维生素B₁在碱性条件下可与铁氰化钾反应生成具有蓝色荧光的硫色素。